抗凝血酶Ⅲ的作用是
A. 封闭凝血因子活性中心
B. 抑制PG
C. 抑制血小板聚集
D. 抑制TXA形成
E. 增加溶解

正确答案：A。封闭凝血因子活性中心